下列关于Kaplan-Meier法适用范围的叙述，正确的是
A. 仅适用于大样本按时间分组资料
B. 仅适用于大样本未按时间分组资料
C. 仅适用于小样本未按时间未分组资料
D. 适用于小样本或大样本按时间分组资料
E. 适用于小样本或大样本未按时间分组资料

正确答案：E。适用于小样本或大样本未按时间分组资料